可促进入类IgE类抗体转换的是
A. IL-5
B. IL-4
C. IFN-γ
D. TNF-α
E. IL-8

正确答案：B。IL-4